女性，85岁。20年来反复发作右面部闪电样疼痛。说话和鼻翼旁触摸诱发疼痛．今年已痛10月未缓解。诊断为三叉神经痛。若为原发性三叉神经痛，应具备的条件是
A. 右角膜反射和右面部痛温觉减退
B. 右面部分离性感觉障碍
C. 右角膜反射存在，右面部痛温觉正常
D. 右角膜反射存在，右侧咀嚼肌无力
E. 右角膜反射减退，右侧咀嚼肌无力

正确答案：C。右角膜反射存在，右面部痛温觉正常

解析：三叉神经痛是原发性三叉神经痛的简称，表现为三叉神经分布区内短暂的反复发作性剧痛，神经系统检查一般无阳性体征（C对）。而继发性三叉神经痛由于常继发于脑神经损害，故有明显的患侧角膜反射减退（E错）、面部痛温觉减退（A错）、面部分离性感觉障碍（B错）、咀嚼肌无力（D错）等脑神经损害症状。